患者，女，70岁，拟行膝关节置换术，无磺胺类药过敏史，皮试结果呈阴性。体征和实验室检查：低热，无感染，空腹血糖4.6mmol/L。手术医师处方抗菌药物预防感染。Ⅰ类清洁手术切口预防性应用抗菌药物的比例不得超出手术病例总数的
A. 0.7
B. 0.6
C. 0.5
D. 0.4
E. 0.3

正确答案：E。0.3

解析：本题考查Ⅰ类清洁手术切口。预防性应用抗菌药物的次数不宜过多，一般不超过手术病例总数的30%（E对）。由于头狍菌素类药物会有过敏反应，因此使用前需进行过皮肤敏感试验，因此使用次数也不宜过高。